6岁患儿，因发热3周，双膝关节痛2周入院。查体：T38℃，P101次/分，咽稍充血，心肺（-），双膝关节红、肿，活动受限，化验血沉98mm/h，CRP阳性，心电图示P-R间期延长。为证实风湿热的诊断，需化验的指标是
A. 血常规
B. 尿常规
C. 粘蛋白
D. ASO
E. 血清抗核抗体

正确答案：D。ASO

解析：本题考查风湿热的辅助检查。6岁患儿，因发热3周，双膝关节痛2周入院。查体：T38℃，P101次/分，咽稍充血，心肺（-），双膝关节红、肿，活动受限，化验血沉98mm/h，CRP阳性，心电图示P-R间期延长。为证实风湿热的诊断，需化验的指标是ASO（D对）。为证实风湿热的诊断，首先应先确定是否有链球菌感染，故选择化验ASO。血常规（A错）、尿常规（B错）、粘蛋白（C错）、血清抗核抗体（E错）是反应风湿热活动的指标，仅能反映疾病的活动情况，对本病的诊断并无特异性。